某女，32岁。患带下赤白半年，近因饮食不洁又湿热泻痢。宜选用的药是
A. 马勃
B. 秦皮
C. 鸦胆子
D. 垂盆草
E. 地锦草

正确答案：B。秦皮

解析：本题考查的是秦皮的主治病证。患带下赤白半年，近因饮食不洁又湿热泻痢。宜选用的药是秦皮（B对）。秦皮：【主治病证】（1）湿热泻痢。（2）赤白带下。（3）目赤肿痛，目生翳膜。马勃（A错）：【主治病证】（1）风热或肺热之咽喉肿痛、咳嗽失音。（2）血热吐衄，外伤出血。鸦胆子（C错）：【主治病证】（1）休息痢（阿米巴痢疾），热毒血痢。（2）疟疾。（3）赘疣，鸡眼（外用）。垂盆草（D错）：【主治病证】（1）疮疡肿毒，毒蛇咬伤，水火烫伤。（2）湿热黄疸，水肿兼热，小便不利。地锦草（E错）：【主治病证】（1）热毒泻痢，疮疖痈肿，毒蛇咬伤。（2）咯血，尿血，便血，崩漏。（3）湿热黄疸。